二甲双胍用于非2型糖尿病患者减肥，属于
A. 超适应证给药
B. 有禁忌证用药
C. 盲目联合用药
D. 撒网式给药
E. 过度治疗用药

正确答案：A。超适应证给药

解析：本题考查用药适宜性审核。二甲双胍可以降低血糖，同时降低体重，适于2型肥胖型糖尿病患者，用于非2型糖尿病患者减肥，属于超适应证给药（A对）。